根据《国际卫生条例》（2005），WHO规定的全球预警和应对的传染性疾病的数量是
A. 37种
B. 39种
C. 24种
D. 25种
E. 20种

正确答案：E。20种

解析：本题考查WHO规定的全球预警和应对的传染性疾病的数量。根据《国际卫生条例》（2005），WHO规定的全球预警和应对的传染性疾病的数量是20种（E对ABCD错）。